既可用于治疗呼吸道合胞病毒感染，也可用于治疗肝功能代偿期的慢性丙型肝炎的药物是
A. 阿比多尔
B. 奥司他韦
C. 博洛昔韦
D. 法匹拉韦
E. 利巴韦林

正确答案：E。利巴韦林

解析：本题考查抗病毒药的分类。既可用于治疗呼吸道合胞病毒感染，也可用于治疗肝功能代偿期的慢性丙型肝炎的药物是利巴韦林（E对）。利巴韦林适用于呼吸道合胞病毒引起的病毒性肺炎与支气管炎，皮肤疱疹病毒感染，肝功能代偿期的慢性丙型肝炎患者。阿比多尔（A错）属于细胞血凝素抑制剂。奥司他韦（B错）属于神经氨酸酶抑制剂类抗流感病毒药。博洛昔韦（C错）、法匹拉韦（D错）属于RNA聚合酶抑制剂类抗流感病毒药。